牙体缺损修复时，有关牙体预备保护牙髓的说法哪项是错误的
A. 用高速切割器械做牙体预备时，应有水雾冷却
B. 局麻下操作应注意保护牙髓
C. 牙体预备一次性完成
D. 活髓牙预备后使用磷酸锌粘固
E. 活髓牙牙体预备后应做临时冠

正确答案：D。活髓牙预备后使用磷酸锌粘固

解析：保护牙髓；牙体预备过程中，应特别注意防止对牙髓的损伤。高温、化学刺激或微生物的侵犯都可引起牙髓不可逆性的炎性反应。①防止温度过高。牙体制备时，金刚车针切割牙体会产热，产热的多少与车针的种类、形状、磨耗情况、旋转速度、术者施压的大小等因素有关。高速手机预备牙体时，必须喷水冷却，防止过热，仅用喷气冷却不足以消除高热对牙髓的危害。高速车针预备时对牙切割面轻轻地施力既能防止温度的升高，又能有效地磨除牙体组织。在对固位沟和针道的预备时，应降低手机转速，因为水的冷却作用很难达到沟和针道的深在部位。如果喷雾水妨碍视线影响对边缘处精修，可降低手机转速。②避免化学性损害。有些修复材料（垫底材料、树脂、粘接剂等）在新鲜牙本质表面对牙髓的刺激性较大，对这种情况应采取护髓措施。③防止细菌感染。去除感染牙本质时力求彻底，但也没有必要常规使用抗生素来预防牙髓炎，因为活髓的牙本质有一定的抗菌能力，且许多牙用材料，包括磷酸锌粘固剂本身具有抗菌作用。掌握“牙体缺损修复治疗原则”知识点。